生用渗利湿热，炒用健脾止泻的药是
A. 泽泻
B. 地肤子
C. 青木香
D. 薏苡仁
E. 车前子

正确答案：D。薏苡仁

解析：本题考查的是薏苡仁的性能特点。生用渗利湿热，炒用健脾止泻的药是薏苡仁（D对）。薏苡仁：【性能特点】本品甘淡渗利兼补，微寒能清，入脾、胃、肺经，利水而不伤正、健脾而不滋腻。生用甘淡微寒，渗利清补，既能清利湿热、除痹排脓，又略兼健脾，湿热或又兼脾虚者宜用。炒用性平，甘淡渗利而兼补，健脾渗湿止泻，脾虚湿盛无热或热不盛者宜用。生用长于利湿、除痹、清热、排脓；炒用长于健脾止泻。泽泻（A错）：【性能特点】本品甘寒渗利清泄，入肾与膀胱经。既利水渗湿，又清泻肾（相）火与膀胱之热，故下焦湿热、痰饮及相火妄动之证皆可选用。地肤子（B错）：【性能特点】本品甘寒清利，苦泄辛散，入肾与膀胱经。既利尿通淋，又祛风止痒，为治热淋及疮疹湿痒之要药。青木香（C错）：【性能特点】本品辛香行散，苦寒清泄，有小毒，力较强。入肝、胃经，能调理肝胃气机而行气止痛，治肝胃气痛有热、脘腹胀痛、痧胀或泻痢腹痛。以毒攻毒，解毒消肿，治蛇虫咬伤、痈肿疔毒及湿疮痒痛。车前子（E错）：【性能特点】本品甘寒质滑清利，入肾经，既利水清热而通淋，又实大便而止泻，治下焦湿热、水肿有热及暑湿水泻；入肝经，清泻肝火而明目，治肝热目赤；入肺经，清肺化痰而止咳，治痰热咳嗽。故凡湿热、肝热、痰热所致病证均可选用。